瘀血疼痛的特点有
A. 刺痛
B. 痛处拒按
C. 痛有定处
D. 痛处可见青紫肿胀
E. 疼痛夜间加重

正确答案：A、B、C、D、E。刺痛；痛处拒按；痛有定处；痛处可见青紫肿胀；疼痛夜间加重

解析：本题考查的是瘀血的致病特点。瘀血疼痛的特点有刺痛（A对）、痛处拒按（B对）、痛有定处（C对）、痛处可见青紫肿胀（D对）与疼痛夜间加重（E对）。瘀血的致病特点：（1）疼痛：多为刺痛，痛处固定不移，拒按，夜间痛甚。（2）肿块：外伤肌肤局部，可见青紫肿胀；积于体内，久聚不散，则形成癥积，按之有痞块，固定不移。（3）出血：血色多呈紫暗色，并伴有血块。另外，临床望诊，往往还可见到面色黧黑、肌肤甲错、唇甲青紫、舌色紫暗或有瘀点、瘀斑，或舌下静脉曲张等表现。切诊则多见细涩、沉弦或结代等脉象。